上颌骨或面中1/3部损伤容易并发除外的是
A. 脑震荡
B. 脑挫伤
C. 颅内血肿
D. 颅底骨折
E. 吸入性窒息

正确答案：E。吸入性窒息

解析：本题考查口腔颌面部创伤概论。上颌骨或面中1/3部损伤容易并发除外的是吸入性窒息（E错，为本题正确答案）。颌面部上接颅脑，上颌骨或面中1/3部损伤容易并发颅脑损伤，包括脑震荡（A对）、脑挫伤（B对）、颅内血肿（C对）和颅底骨折（D对）等，其主要临床特征是伤后有昏迷史。颅底骨折时可有脑脊液由鼻孔或外耳道流出。